确诊宫颈癌最可靠的方法是
A. 宫颈刮片细胞学检查
B. 阴道镜检查
C. 碘试验
D. 宫颈及颈管活体组织检查
E. 分段诊刮

正确答案：D。宫颈及颈管活体组织检查